女性，35岁，25MO嵌体，远中面深龋，X线片示根充完善，余无异常。最佳修复治疗方案是
A. DO树脂充填
B. MOD嵌体
C. 全冠
D. 桩核冠
E. 覆盖义齿

正确答案：D。桩核冠

解析：患牙MO嵌体，又有远中面龋，形成MOD缺损，对于前磨牙而言，缺损过大，牙冠剩余组织抗力不足，不宜采取充填、嵌体修复。即使采取全冠修复，也可能发生冠折。正确的方法是适当去除薄弱牙体组织，进行桩核冠修复，覆盖义齿的修复效果显然不如桩核冠。掌握“牙体缺损修复体固位及适应、禁忌证”知识点。